最符合高分化鳞癌组织学特点的是
A. 列兵样排列
B. 形成管状结构
C. 形成乳头状结构
D. 有角化珠
E. 有假菊形团结构

正确答案：D。有角化珠

解析：高分化鳞癌的组织学特点是癌巢中央出现层状角化物，即角化珠（D对）。癌细胞呈列兵样排列（A错）是乳腺浸润性小叶癌（P304）的组织学特点。癌细胞形成管状结构（B错）或乳头状结构（C错）均可见于上皮组织的肿瘤中，无特异性。癌细胞呈假菊形团结构（E错）是肺小细胞癌（P183）的组织学特点。